制备时修复体轴壁聚合度过大，易造成
A. 疼痛
B. 脱落
C. 穿孔
D. 咬合不良
E. 支持力不足

正确答案：B。脱落

解析：修复体固位不足，如轴壁聚合度过大，（牙合）龈距太短，修复体不密合，桩过短，固位型不良。掌握“修复体戴入后的问题及处理”知识点。